无排卵性功能失调性子宫出血患者诊断性刮宫的病理结果不可能出现的项目是
A. 分泌期和增生期内膜并存
B. 单纯性增生
C. 复杂性增生
D. 萎缩型子宫内膜
E. 增生性子宫内膜

正确答案：A。分泌期和增生期内膜并存

解析：无排卵性功血患者的子宫内膜受雌激素持续作用而无孕激素拮抗，可有不同程度的增生性改变，少数可呈萎缩性改变，可分为：（1）子宫内膜增生症，包括①单纯型增生（B对）②复杂型增生（C对）③不典型增生 （2）增生性期子宫内膜（E对）与正常月经周期中的增生期内膜无区别 （3）萎缩型子宫内膜（D对）。因无孕激素拮抗，子宫内膜不能从增生期转化为分泌期，故无排卵性功能失调性子宫出血患者，诊断性刮宫的病理结果不可能出现分泌期和增生期内膜并存（A错，为本题正确答案），其可见于排卵性功能失调性子宫出血的子宫内膜病理改变。